自中药中提取苷类成分可选用的溶剂有
A. 水
B. 乙醇
C. 乙酸乙酯
D. 乙醚
E. 石油醚

正确答案：A、B。水；乙醇

解析：本题考查的是中药化学成分的提取。自中药中提取苷类成分可选用的溶剂有水（A对）与乙醇（B对）。中药化学成分的提取：从药材中提取化学成分的方法有溶剂法、水蒸气蒸馏法及升华法等。后两种方法的应用范围十分有限，大多数情况下是采用溶剂法。溶剂法系选择适当溶剂将中药中的化学成分从药材中提取出来。一般如无特殊规定，药材需经干燥并适当粉碎，以利于增大与溶剂的接触表面，提高萃取效率。一般而言，植物成分中，萜类、甾体等脂环类及芳香类化合物因为极性较小，易溶与三氯甲烷、乙醚（D错）等亲脂性溶剂中；而糖苷、氨基酸等类成分则极性较大，易溶于水及含水醇中；至于酸性、碱性及两性化合物，因为存在状态（分子或离子形式）随溶液而异，故溶解度将随pH而改变。乙酸乙酯（C错）与石油醚（E错）属于亲脂性溶剂，适宜提取极性较小的化学成分。